下列关于药品召回的说法，不正确的是
A. 药品上市许可持有人是药品召回的责任主体
B. 对于使用后可能引起严重健康危害的药品，应当实施三级召回
C. 药品经营企业应当协助药品上市许可持有人有人履行召回义务
D. 进口药品需要在境内进行召回时，由进口的企业负责具体实施

正确答案：B。对于使用后可能引起严重健康危害的药品，应当实施三级召回

解析：本题考查药品召回分级。根据药品安全隐患的严重程度，药品召回分为三级：对使用该药品可能引起严重健康危害的实施一级召回（B错，为本题正确答案）。药品上市许可持有人是药品召回的责任主体（A对）。企业应当协助药晶上市许可持有人履行召回义务（C对），按照召回计划的要求及时传达、反馈药品召回信息，控制和收回存在安全隐患的药品，并建立药品召回记录。进口药品需要在境内进行召回的，由进口的企业负责具体实施（D对）。